以下属于幼儿期阶段特点的描述是
A. 智能发育较快
B. 好奇心强，自我保护能力差
C. 意外事故较多见
D. 营养障碍性疾病及腹泻病亦较多见
E. 以上均是

正确答案：E。以上均是

解析：幼儿期：1周岁后到满3周岁之前。特点：①体格生长速度稍减慢；②智能发育较快，语言、思维、应人应物能力及自我意识发展迅速；③开始行走，活动范围增大，好奇心强，自我保护能力差；④饮食变化大，由乳类向成人饮食过渡；⑤意外事故较多见，营养障碍性疾病及腹泻病亦较多见。故应防止意外创伤和中毒，加强断奶后的营养和喂养指导，重视传染病的预防工作，还应着手进行生活习惯和卫生习惯的培养和训练。掌握“小儿年龄分期”知识点。